可沉淀胶液杂质，并增加胶剂透明度辅料是
A. 冰糖
B. 麻油
C. 黄油
D. 花生油
E. 明矾

正确答案：E。明矾

解析：本题考查的是胶剂的辅料的种类与作用。可沉淀胶液杂质，并增加胶剂透明度辅料是明矾（E对）。胶剂辅料的种类与作用：①冰糖（A错）：色白、洁净无杂质者为佳。冰糖可增加胶剂的透明度和硬度，并有矫味作用。也可用白糖代替。②油类：可用花生油（D错）、豆油、麻油（B错），纯净无杂质的新制油为佳，酸败者禁用。油可降低胶块的黏度，便于切胶，且在浓缩收胶时，油可促进锅内气泡的逸散，起消泡的作用。③酒类：多用绍兴黄酒（C错），也可用白酒代替。酒起矫味矫臭作用，收胶时有利于气泡逸散。④明矾：色白洁净者为佳。可沉淀胶液中的泥沙杂质，增加胶剂的透明度。